感染性休克为
A. 高阻力型休克
B. 低阻力型休克
C. 两者均有
D. 两者均无
E. 无

正确答案：C。两者均有

解析：脓毒性休克是指病原微生物（如细菌、病毒、真菌、立克次体等）感染所引起的休克，是感染性休克的一种，按其血流动力学变化可分为两种类型(—)高动力型休克又称为高排低阻型休克（B对）（二）低动力型休克又称低排高阻型休克（A对，C为本题正确答案）。